具有温阳补血散寒通滞功效的方剂是
A. 黄芪桂枝五物汤
B. 小活络丹
C. 补阳还五汤
D. 阳和汤
E. 当归四逆汤

正确答案：D。阳和汤

解析：阳和汤方含熟地黄、麻黄、鹿角胶、白芥子、肉桂、生甘草、炮姜炭，可温阳补血，散寒通滞（D对）--方中重用熟地大补营血为君；鹿角胶生精补髓，养血温阳为臣；姜炭破阴和阳，肉桂温经通脉，白芥子消痰散结，麻黄调血脉，通腠理，均以为佐；生甘草解脓毒而和诸药为使。诸药合用，共奏温阳补血，散寒通滞之效。黄芪桂枝五物汤功效为益气温经，和血通痹（A错）。小活络丹功效为祛风除湿，化痰通络，活血止痛（B错）。补阳还五汤功效为补气活血通络（C错）。当归四逆汤功效为温经散寒，养血通脉（E错）。